舌由下列的哪一组神经分布
A. 上颌神经、面神经、舌咽神经、副神经
B. 上颌神经、舌下神经、舌咽神经、面神经
C. 舌下神经、舌咽神经、副神经、面神经
D. 上颌神经、舌下神经、迷走神经、面神经
E. 面神经、三叉神经、舌咽神经、舌下神经

正确答案：E。面神经、三叉神经、舌咽神经、舌下神经

解析：舌由面神经、三叉神经、舌咽神经、舌下神经（E对）支配。面神经的特殊内脏感觉纤维传导舌前2/3味觉；三叉神经的分支舌神经的一般躯体感觉纤维传导舌前2/3黏膜感觉；舌咽神经的特殊内脏感觉纤维传导舌后1/3味觉，一般内脏感觉纤维传导舌后1/3黏膜感觉；舌下神经的一般躯体运动纤维支配舌内肌、大部分舌外肌运动。